男，18岁。双下肢及颜面水肿1周。实验室检查：尿蛋白12.2g/d，RBC0～2/高倍视野，血Alb18g/L，Cr79mol/L，ANA（-），乙型肝炎病毒标志物均（-）。该患者最可能的肾脏病理类型是
A. 毛细血管内增生性肾小球肾炎
B. 膜增生性肾小球肾炎
C. 膜性肾病
D. 局灶节段性肾小球硬化
E. 微小病变型肾病

正确答案：E。微小病变型肾病

解析：患者为青少年男性（微小病变型肾病的好发年龄），病程1周，具有大量蛋白尿（尿蛋白12.2g/d，尿蛋白定量＞3.5g/d即为大量蛋白尿）、低蛋白血症（血Alb18g/L，血白蛋白＜30/L即为低白蛋白血症）、高度水肿（双下肢及颜面水肿），余检查均正常，符合肾病综合征的诊断标准。膜增生性肾小球肾炎（B错）、膜性肾病（C错）、局灶节段性肾小球硬化（D错）及微小病变型肾病均为肾病综合征的常见病理类型，但好发于青少年的病理类型为微小病变型肾病，因此，该患者最可能的肾脏病理类型是微小病变型肾病（E对）。毛细血管内增生性肾小球肾炎（A错）即急性肾小球肾炎，常表现为肾炎综合征，而不表现为肾病综合征。均有不同程度的肾功能损害。